国际上评价烟草燃烧产生的有害物质含量的三个主要指标是
A. 尼古丁、焦油、烟尘
B. 尼古丁、焦油、一氧化碳
C. 焦油、尼古丁、潜在致癌物
D. 二氧化碳、尼古丁、焦油
E. 一氧化碳、烟尘、尼古丁

正确答案：B。尼古丁、焦油、一氧化碳